听觉的神经传导通路
A. 由四级神经元组成
B. 由三级神经元组成
C. 神经纤维终止于大脑皮质的颏上回
D. 由两级神经元组成
E. 无

正确答案：A。由四级神经元组成

解析：听觉的神经传导通路由四级神经元组成（A对），听觉传导通路的第1级神经元为蜗神经节内的双极神经细胞，第2级神经元胞体在蜗腹侧核和蜗背侧核内，第3级神经元胞体在下丘核，第4级神经元胞体在内侧膝状体，止于止于大脑皮质颞横回的听觉区（C错）。